有关牙髓钙化说法错误的是
A. 髓石形成
B. 弥散性钙化
C. 髓石形成多见于髓室
D. 髓石易引起一系列的临床症状
E. 牙髓组织有营养不良或组织变性

正确答案：D。髓石易引起一系列的临床症状

解析：本题考查牙髓变性。有关牙髓钙化说法错误的是髓石易引起一系列的临床症状（D错，为本题正确答案）。牙髓钙化是指牙髓组织有营养不良或组织变性，在此基础上钙盐沉积形成的大小不等的钙化团块。牙髓钙化有两种形式，一是髓石形成，另一种是弥散性钙化。髓石形成多见于髓室，为一些大小不等圆形或卵圆形的钙化团块，常围绕一核心层层沉积，部分髓室内含有不规则的牙本质小管。髓石可游离于髓室内，或附着于髓室壁，有时充满髓室使根管不通，妨碍牙髓和根管治疗。髓石一般不引起临床症状。弥散性钙化是在牙髓内沉积无数细小钙盐颗粒，犹如砂粒状，常见于根髓内，弥散地沉积在根髓组织上，小颗粒互相融合而成较大团块。